包装材料聚氯乙烯（PVC）的性能不包括
A. 抗湿防潮性好
B. 抗空气透过性好
C. 抗酸碱性差
D. 耐热性好
E. 毒性大

正确答案：E。毒性大